男，25岁，发现血尿、蛋白尿2年。查体：BP150/90mmHg，双下肢无水肿。实验室检查：尿蛋白定量0.5～0.8g/d，尿RBC5～10/HP，血Cr125μmol/L，血胆固醇6.0mmol/L。B超表示双肾大小正常。该患者目前首选的治疗药物是
A. 糖皮质激素
B. 他汀类降脂药
C. 血管紧张素转换酶抑制剂
D. 利尿剂
E. 阿司匹林

正确答案：C。血管紧张素转换酶抑制剂

解析：患者青年男性，BP150/90mmHg（正常值90～139/60～89mmHg，提示轻度高血压），双下肢无水肿，实验室检查结果示：尿蛋白定量0.5～0.8g/d（当尿蛋白超过150mg/d，称为蛋白尿，提示患者有轻度蛋白尿），尿RBC5～10/HP（离心后尿沉渣镜检每高倍视野红细胞超过3个为显微镜下血尿，提示患者轻度镜下血尿），血Cr（血肌酐）125μmol/L（正常值44～133μmol/L），B超表示双肾大小正常，因此可得该患者最可能的临床诊断为慢性肾炎。该患者最重要的治疗措施是控制血压，防止高血压对肾脏进一步损害，首选的治疗药物是血管紧张素转换酶抑制剂（C对）。糖皮质激素（A错）一般不用于降压。此患者血胆固醇稍偏高（正常值＜5.2mmol/L），可用他汀类降脂药降低血胆固醇，患者最重要的治疗措施是控制血压，他汀类降脂药（B错）并不是首选用药。利尿剂（D错）适用于轻、中度高血压，合并心力衰竭和老年人高血压等，不适合此患者降压。阿司匹林（P232）（E错）为抗血小板聚集药物，主要用于冠心病患者防治血栓。